拔除上颌第一磨牙时，牙根完整拔除，但上颌窦有直径约4mm大小的穿孔，患者的最佳处理方法是
A. 立即行上颌窦瘘修补术
B. 拔牙后常规处理，待其自然愈合
C. 牙槽窝填塞碘仿纱条
D. 拔牙后常规处理，将两侧牙龈拉拢后缝合
E. 按干槽症治疗方法处理

正确答案：D。拔牙后常规处理，将两侧牙龈拉拢后缝合

解析：已有交通时，如中等大小的穿孔（直径2～6mm）也可按拔牙后常规处理，将两侧牙龈拉拢后缝合。掌握“牙槽外科”知识点。